动物试验外推到人通常方法不包括
A. 利用不确定系数
B. 利用药动学外推
C. 利用药效学外推
D. 利用数学模型

正确答案：C。利用药效学外推

解析：本题考查动物试验外推到人的方法。动物试验结果外推到人通常有三种基本的方法：利用不确定系数（A对）、利用药动学外推（B对）和利用数学模型（D对）。利用药效学外推（C错，为本题正确答案）不属于动物试验外推到人的方法。